急性普通型肝炎，肝坏死的类型为
A. 碎片状坏死
B. 大片坏死
C. 桥接坏死
D. 点状坏死
E. 灶状坏死

正确答案：D。点状坏死

解析：急性普通型肝炎的病变轻微，肝细胞常见点状坏死（D对）。碎片状坏死（灶性坏死）常见于慢性肝炎（AE错）。大片坏死（B错）常见于重型肝炎。桥接坏死（C错）常见于中度和重度慢性肝炎。